以下有关种植体受植区的要求叙述，不正确的是
A. 保留舌腭侧骨质厚度至少1.5mm
B. 一般种植体长度不应少于8～10mm
C. 种植体与自然邻牙之间不能少于2mm
D. 保留颊侧骨质厚度至少3mm
E. 种植体末端距离下颌管不能少于2mm

正确答案：D。保留颊侧骨质厚度至少3mm

解析：受植区的要求：种植体唇颊、舌腭侧骨质应健康，且厚度不能少于1.5mm，种植体之间不能少于2mm，种植体和天然牙之间不少于2mm。种植体末端距离下颌管不能少于2mm。一般种植体长度不应少于8～10mm。另外种植体周围存在一定宽度的健康附着牙龈是确保种植义齿修复美学效果的重要因素。掌握“牙种植手术及效果评估”知识点。